有权对收受药物经营企业财物的医务人员做出没收违法所得的处罚的单位是
A. 卫生计生行政部门
B. 公安机关
C. 食品药品监督管理部门
D. 医师协会
E. 工商行政管理部门

正确答案：A。卫生计生行政部门

解析：该医院几名医师在处方时使用M药厂生产的药品，并收受了药厂给予的提成，按照《药品管理法》第九十一条规定，医疗机构的负责人、药品采购人员、医师等有关人员收受药品生产企业、药品经营企业或者其代理人给予的财务或者其他利益的，应由卫生行政部门（A对）或者本单位给予医师处分，没收违法所得；对违法行为情节严重的执业医师，由卫生行政部门吊销其执业证书；构成犯罪的，依法追究刑事责任。